“精密量取”时应选用的计量器具是
A. 量筒
B. 称量瓶C
C. 分析天平
D. 移液管
E. 量杯

正确答案：D。移液管